小儿哭声绵长，口作吮乳状，多为
A. 饥饿
B. 口疮
C. 腹痛
D. 咽喉水肿
E. 尿布潮湿不适

正确答案：A。饥饿

解析：啼哭是婴儿的语言，是新生儿的一种本能。新生儿乃至婴幼儿常以啼哭表达要求和痛苦，若因饥饿引起的啼哭多绵长无力，口作吮乳状（A对）。口疮（B错）表现为哭叫拒食，伴流涎烦躁，可以观察到齿龈、舌体、两颊、上颚等处出现黄白色溃疡。腹痛（C错）引起的啼哭声尖锐，忽缓忽急，时作时止。咽喉水肿（D错）多为哭声嘶哑，伴呼吸不利。尿布潮湿不适（E错）引起啼哭表现为声调一致，哭声洪亮而长，有泪状。